上呼吸道感染可引起中耳发炎，其途径可能是经过
A. 咽隐窝
B. 面神经管
C. 咽鼓管
D. 颈动脉管
E. 骨半规管可分为前、后、外侧3个

正确答案：C。咽鼓管

解析：上呼吸道主要指鼻腔，咽，喉。中耳由鼓室、咽鼓管、乳突窦和乳突小房组成。因为咽鼓管为连通鼻咽部与鼓室的通道，所以此题选C。